哪种膳食容易引起维生素B₁₂的缺乏
A. 不吃肉
B. 不吃水果
C. 不吃蔬菜
D. 不吃谷物
E. 不吃牛奶

正确答案：A。不吃肉